流行病学试验要求当样本量确定后，必须遵循随机化原则将研究对象随机分配到试验组与对照组，其理由是
A. 可消除各种偏倚
B. 从工作方便出发
C. 可提高依从性
D. 可平衡试验组和对照组的混杂因素，提高可比性
E. 可制止医德方面的争议

正确答案：D。可平衡试验组和对照组的混杂因素，提高可比性